下列有关可摘局部义齿设计原则，不正确的是
A. 义齿应恢复咀嚼功能
B. 义齿应恢复发音功能
C. 义齿应恢复美观功能
D. 义齿不易摘戴
E. 义齿应制作简便

正确答案：D。义齿不易摘戴

解析：可摘局部义齿设计原则：义齿应恢复因缺牙导致的咀嚼、发音和美观功能障碍。义齿应摘戴方便，戴义齿后感觉舒适。义齿应制作简便，结构简单，容易保持清洁，坚固耐用。掌握“局部义齿的设计”知识点。